由政府价格主管部门按照定价权限和范围制定的价格是
A. 政府指导价
B. 政府定价
C. 集中招标采购
D. 市场调节价
E. 调节价

正确答案：A。政府指导价